肌腱构成髌韧带的是
A. 股二头肌
B. 半腱肌
C. 半膜肌
D. 股四头肌
E. 缝匠肌

正确答案：D。股四头肌

解析：肌腱构成髌韧带的是股四头肌（D对）。